妊娠期高血压基本病变是
A. 全身小动脉痉挛
B. 全身小静脉痉挛
C. 全身动脉痉挛
D. 全身静脉痉挛
E. 心脏小动脉痉挛

正确答案：A。全身小动脉痉挛